用于血药浓度测定的方法有
A. 化学法
B. 光谱法
C. 色谱法
D. 免疫法
E. 高效毛细电泳法

正确答案：C、D。色谱法；免疫法

解析：本题考查体内药物检测。用于血药浓度测定的方法有免疫分析法（D对）和色谱分析法（C对）。化学分析法（A错）是依赖于特定的化学反应及其计量关系来对物质进行分析的方法。光谱法（B错）是由原子外层或内层电子 能级的变化产生的，它的表现形式为线光谱，用于特定波长处具有显著吸收的有关物质检测。高效毛细电泳法（E错）是以高压电场为驱动力，以毛细管为分离通道，依据样品中各组分之间淌度和分配行为上的差异而实现分离分析的液相分离方法。